主要通过增强心肌收缩力而改善心功能的药物是
A. 卡维地洛
B. 硝酸甘油
C. 地高辛
D. 氢氯噻嗪
E. 依那普利

正确答案：C。地高辛

解析：本题考查地高辛。地高辛（C对）属于强心苷类药物，能够抑制心肌细胞膜Na⁺，K⁺-ATP酶，使细胞内Na⁺水平升高，促进Na⁺-Ca²⁺交换，提高细胞内Ca²⁺水平，从而发挥正性肌力作用。卡维地洛（A错）为非选择性β受体阻断药。硝酸甘油（B错）进入平滑肌分解出NO松弛平滑肌起作用。氢氯噻嗪（D错）为利尿药。依那普利（E错）为血管紧张素转化酶抑制剂。